下列关于五脏所藏的叙述，错误的是
A. 心藏神
B. 肝藏魂
C. 肺藏魄
D. 脾藏意
E. 肾藏智

正确答案：E。肾藏智

解析：本题考查五脏的生理活动与精神情志的关系，属记忆内容。心藏神（A对），肺藏魄（C对），肝藏魂（B对），脾藏意（D），肾藏志（E错，为本题正确答案）。